选择性阻滞钙通道、抑制Ca²⁺内流的抗心律失常药物是
A. 胺碘酮
B. 普鲁卡因
C. 普萘洛尔
D. 利多卡因
E. 维拉帕米

正确答案：E。维拉帕米

解析：本题考查维拉帕米。维拉帕米（E对）作为钙通道阻滞剂，主要抑制L-型钙通道的钙离子内流，延长窦房结和房室结有效不应期和功能不应期，减慢窦房结的自律性和房室结的传导。临床用于心绞痛、室上性心律失常，原发性高血压。胺碘酮（A错）为延长动作电位时程药，属于广谱抗心律失常药。普鲁卡因胺（B错）属于Ⅰa类抗心律失常药，能延长心房的不应期，降低房室的传导性及心肌的自律性，主要适用于危及生命的室性心律失常。普萘洛尔（C错）是β受体阻断剂，能有效的控制交感神经活性，减轻由β受体介导的心律失常。主要用于治疗室上性心律失常。利多卡因（D错）属于Ib类抗心律失常药，仅用于室性心律失常。